下列属于无阈值效应的是
A. 汞所致的中毒性脑病
B. 四氯化碳所致的肝细胞坏死
C. 氢氟酸所致的皮肤灼伤
D. 阿司匹林所致的胎儿畸形
E. 氯乙烯所致的肝血管肉瘤

正确答案：E。氯乙烯所致的肝血管肉瘤